抢救氰化物中毒最有效的办法是尽早使用
A. 硫代硫酸钠
B. 亚硝酸钠
C. 小剂量美兰
D. 先用亚硝酸钠，再用硫代硫酸钠
E. 先小剂量美兰，再用硫代硫酸钠

正确答案：D。先用亚硝酸钠，再用硫代硫酸钠

解析：本题考查氰化物的急救措施。“亚硝酸钠－硫代硫酸钠”疗法：立即将亚硝酸异戊酯1～2支包在手帕或纱布内打碎，给病人吸入15～30秒，每隔3分钟重复应用1支（一般最多用6支），直至使用亚硝酸钠为止。接着静脉缓慢注射3%亚硝酸钠10～15ml，约2～3ml/min，注射时应密切观察血压，防止血压下降，必要时可隔0.5～1小时重复l次。随即用同一针头缓慢静脉注射25%硫代硫酸钠（D对ABCE错）溶液50～60ml。用药30分钟后病情未缓解时，可按半量或全量再给亚硝酸钠和硫代硫酸钠，并可持续3～4天。